在提呈低浓度抗原方面发挥重要作用的APC是
A. MΦ
B. DC细胞
C. B细胞
D. 嗜酸性粒细胞
E. 成纤维细胞

正确答案：C。B细胞